下列可作为润湿剂的是
A. 羧甲基淀粉钠
B. 硬脂酸镁
C. 乳糖
D. 羟丙基甲基纤维素溶液
E. 水

正确答案：E。水

解析：本题考查片剂的常用辅料。润湿剂系指本身没有黏性，而通过润湿物料诱发物料黏性的液体，常用的润湿剂有蒸馏水（E对）和乙醇，其中蒸馏水是首选的润湿剂。羧甲基淀粉钠（A错）为崩解剂。硬脂酸镁（B错）为润滑剂。乳糖（C错）为填充剂。羟丙基甲基纤维素溶液（D错）为黏合剂。